下列各结构中何者经过海绵窦内
A. 嗅神经
B. 视神经
C. 展神经
D. 舌下神经
E. 无

正确答案：C。展神经

解析：嗅神经（A错）为特殊内脏感觉纤维，穿鼻顶壁的筛板筛孔入颅前窝连于嗅球。视神经（B错）向后内行经视神经管入颅中窝，移行于间脑的视交叉。舌下神经（D错）起自延髓舌下神经核，在延髓锥体与橄榄体之间出脑，经舌下神经管出颅。展神经由一般躯体运动纤维组成，经过海绵窦内，经眶上裂入眶（C对）。